巨噬细胞主要是通过以下哪种方式摄入和消化细菌的
A. 胞饮作用
B. 受体介导的胞吞作用
C. 泡膜运输的方式
D. 吞饮作用
E. 吞噬作用

正确答案：E。吞噬作用